下列有关预贮备介质主要有
A. 细胞因子
B. 前列腺素
C. 激肽原酶
D. 白细胞三烯
E. 血小板活化因子

正确答案：C。激肽原酶

解析：预贮备介质：主要有组胺和激肽原酶。组胺的生物活性是使小静脉和毛细血管扩张，通透性增强；刺激支气管胃肠道、子宫和膀胱等处平滑肌收缩；促进黏膜、腺体分泌增多。组胺可引起下述症状：皮肤、黏膜充血水肿，荨麻疹，鼻塞，流鼻涕，支气管哮喘，恶心，呕吐、腹泻等。激肽原酶作用于血浆中的激肽原产生激肽，其中的缓激肽有以下作用：刺激平滑肌收缩，引起支气管痉挛；扩张毛细血管使其通透性增强；趋化白细胞：刺激痛觉神经引起疼痛。掌握“概述及Ⅰ型超敏反应”知识点。